下列哪项不是胎儿的附属物
A. 胎盘
B. 脐带
C. 蜕膜
D. 羊水
E. 胎膜

正确答案：C。蜕膜

解析：本题考查妊娠生理。蜕膜（C错，为本题正确答案）不是胎儿的附属物。胎儿附属物包括胎盘（A对）、胎膜（E对）、脐带（B对）和羊水（D对）。